在急性腹膜炎的情况下，下列哪一种原因最常引起早期发热
A. 胃十二指肠溃疡穿孔
B. 急性阑尾炎、胆囊炎穿孔
C. 实质性脏器破裂
D. 结肠破裂早期
E. 代谢性酸中毒

正确答案：B。急性阑尾炎、胆囊炎穿孔

解析：腹腔空腔脏器穿孔、外伤引起的腹壁或内脏破裂，是急性腹膜炎的最常见原因。病因不同，腹膜炎的症状也会有一定的差异。阑尾炎、胆囊炎为感染性疾病，因此其穿孔引起的腹膜炎早期即会出现发热症状（B对）。胃十二指肠穿孔（A错）、实质性脏器破裂（C错）、结肠破裂（D错）的早期多为消化液或血液流入腹腔引起的化学性腹膜炎，一般无发热表现，晚期继发感染后可出现发热、脉快等感染中毒症状。代谢性酸中毒（E错）指细胞外液中H⁺增加或HCO₃⁻减少而引起机体pH降低，是一种常见的酸碱平衡紊乱，一般不会引起腹膜炎。